郄穴共有多少个
A. 16个
B. 14个
C. 12个
D. 18个
E. 24个

正确答案：A。16个

解析：郄穴是十二经脉和奇经八脉中阴维、阳维、阴跷、阳跷脉之经气深聚的部位，共16个（A对），除胃经的梁丘穴外都分布于四肢肘膝关节。